老年人合用3～4种药物，属于
A. 不用或少用药物
B. 选择适当的剂量
C. 药物治疗要适度
D. 提高用药依从性
E. 根据生理特点合理选择药物

正确答案：A。不用或少用药物

解析：本题考查特殊人群用药。老年人多重用药会带来各种用药风险和由药物相互作用导致的不良反应，因此老年人不用或使用最少的药物（A对）来治疗。老年人初始用药应从小剂量开始（B错），逐渐增加至治疗剂量。老年人药物治疗要适度（C错）。老年人用药依从性较差会导致药效降低、病情进展（D错）。老年人应根据生理特点合理选择药物（E错）。